组成药物中含有熟地黄、肉桂的方剂是
A. —贯煎
B. 暖肝煎
C. 肾气丸
D. 炙甘草汤
E. 地黄饮子

正确答案：E。地黄饮子

解析：本题考查方剂的组成，属于记忆内容。地黄饮子功用滋肾阴，补肾阳，开窍化痰，由熟干地黄、巴戟天、山茱萸、石斛、肉苁蓉、附子、五味子、官桂、白茯苓、麦门冬、菖蒲、远志、生姜、大枣组成，含有熟地黄、肉桂（E对）。—贯煎功用滋阴疏肝，由北沙参、麦冬、当归身、生地黄、枸杞子、川楝子，不含有熟地黄、肉桂（A错）。暖肝煎功用温补肝肾，行气止痛，由当归、枸杞子、小茴香、肉桂、乌药、沉香、茯苓组成，不含有熟地黄、肉桂（B错）。肾气丸功用补肾助阳，由干地黄、薯蓣、山茱萸、泽泻、茯苓、牡丹皮、桂枝、附子组成，不含有熟地黄、肉桂（C错）。炙甘草汤功用益气滋阴，通阳复脉，由甘草、生姜、桂枝、人参、生地黄、阿胶、麦门冬、麻仁、大枣组成，不含有熟地黄、肉桂（D错）。趣记：地黄饮子山茱斛，领子出门昌远归。